患者年高体衰，病属虚寒，久已卧床不起今日晨起突然面色泛红，烦热不宁，语言增多，并觉口渴喜饮，舌淡，脉大而无根其病机是
A. 阴盛格阳
B. 阳虚阴盛
C. 阳损及阴
D. 阳气亡失
E. 阴阳离决

正确答案：A。阴盛格阳

解析：阳气极虚，寒盛于内是疾病的本质，可见面色苍白，四肢厥冷，精神萎靡，畏寒跪卧，溲清便溏，舌淡苔白，脉微欲绝等症状；逼迫阳气浮越于体表，可在原有寒盛于内表现的基础上，反见身热，烦躁，口渴等假热之象，称为“格阳”；若阴盛于下，虚阳浮越，可见面赤，称为“戴阳”。仔细观察，则身虽热，反喜盖衣被；口虽渴而饮水不多，喜热饮，或漱水而不欲饮；手足躁动，但神态清楚；面虽红，却浮如妆，游移不定，可作辨别。该患者年高体衰，病属虚寒，久已卧床不起，体内阴寒内盛，阳气虚衰至极，则阴寒闭塞于内，格拒阳气于外，从而出现真寒假热之证（A对）。